患者，女，27岁，已婚。产后恶露35天不止，色深红、质稠粘、有臭味，口燥咽干，舌红，脉虚细而数。治疗应首选
A. 清热固经汤
B. 保阴煎
C. 清热调血汤
D. 清经散
E. 牡丹散

正确答案：B。保阴煎

解析：患者产后35天恶露仍不止，且色深红，质粘稠，有臭气，口燥咽干，舌红，脉虚细而数属血热内扰之象，方用保阴煎以养阴清热止血（B对）。清热固经汤功效清热凉血，固冲止血，多用于实热内蕴，损伤冲任，血海沸溢，血液妄行等证（A错）。清热调血汤功效清热除湿，化淤止痛，多用于经前经期小腹灼热胀痛，拒按，经色暗红，质稠有块，且平时带下色黄，味臭秽，苔黄腻，脉弦数或濡数（C错）。清经散功效清热凉血调经，原方多用于治疗月经先期量多者（D错）。牡丹散主治肺痈，血虚劳倦，五心烦热，肢体疼痛，头目昏重，口燥咽干，发热盗汗，减食嗜卧，及血热相搏，月水不利等证（E错）。